根据卫生部第九部委局《关于建立国家基本药物制度的实施意见》，基本药物纳入基本医疗保障药品报销目录的比例是
A. 0.6
B. 0.7
C. 0.8
D. 0.9
E. 1

正确答案：E。1

解析：本题考查医疗保障制度。《关于建立国家基本药物制度的实施意见》第十六条规定，基本药物全部纳入基本医疗保障药品报销目录，纳入比例100%（E对）。